与药物性牙龈肥大有关的药物是
A. 环孢素
B. 螺旋霉素
C. 多西环素
D. 阿莫西林
E. 甲硝唑

正确答案：A。环孢素

解析：本题考查药物性牙龈肥大的病因。与药物性牙龈肥大有关的药物是环孢素（A对）。与药物性龈肥大有关的三类常用药物是：①抗癫痫药物，如苯妥英钠；②免疫抑制剂，如环孢素；③钙通道阻滞剂，如硝苯地平、维拉帕米等。